抢救其所致过敏性休克需用肾上腺素的药物是
A. 青霉素
B. 链霉素
C. A和B均是
D. A和B均不是

正确答案：C。A和B均是

解析：本题考查青霉素和链霉素的不良反应。抢救其所致过敏性休克需用肾上腺素的药物是青霉素、链霉素（C对）。青霉素引发过敏性休克时，除采取一般急救措施外，应立即皮下或肌内注射肾上腺素0.5～1.0mg。链霉素一旦发生过敏性休克，宜静注葡萄糖酸钙及注射肾上腺素等抢救。